药物制剂常用的表面活性剂中，毒性最大的是
A. 高级脂肪酸盐
B. 卵磷脂
C. 聚山梨酯
D. 季铵化合物
E. 蔗糖脂肪酸酯

正确答案：D。季铵化合物

解析：本题考查表面活性剂的毒性。药物制剂常用的表面活性剂中，毒性最大的是季铵化合物（D对）。表面活性剂的毒性顺序为：阳离子型表面活性剂>阴离子型表面活性剂>非离子型表面活性剂。在酸性与碱性溶液中均较稳定，具有良好的表面活性作用和杀菌、防腐作用。高级脂肪酸盐（A错）为阴离子型表面活性剂；卵磷脂（B错）为两性离子型表面活性剂；聚山梨酯（C错）、蔗糖脂肪酸酯（E错）均为非离子型表面活性剂。